2009年国家卫生部发布的《全国自然灾害卫生应急预案》将自然灾害按性质分为几类
A. 5
B. 6
C. 7
D. 8
E. 9

正确答案：C。7